正细胞贫血可见于
A. 缺铁性贫血
B. 巨幼细胞性贫血
C. 骨髓增生异常综合征
D. 再生障碍性贫血
E. 多发性骨髓瘤

正确答案：D。再生障碍性贫血

解析：属于正细胞贫血的是再生障碍性贫血（D对）。缺铁性贫血（A错）属于小细胞低色素性贫血。巨幼细胞性贫血（B错）、骨髓增生异常综合征（C错）属于大细胞型贫血。多发性骨髓瘤（E错）贫血的发生主要为红细胞生成减少所致，与骨髓瘤细胞浸润抑制造血、肾功能不全等有关。